下列事物或现象中，属于“火”者是
A. 五味中的辛
B. 五色中的赤
C. 五化中的长
D. 五季中的长夏
E. 五方中的南

正确答案：B、C、E。五色中的赤；五化中的长；五方中的南

解析：本题考查的是事物属性的五行归类。下列事物或现象中，属于“火”者是五色中的赤（B对）、五化中的长（C对）、五方中的南（E对）。自然界中五音：角、徵、宫、商、羽；五味：酸、苦、甘、辛（A错）、咸；五色：青、赤、黄、白、黑；五化：生、长、化、收、藏；五气：风、暑、湿、燥、寒；方位：东、南、中、西、北；季节：春夏、长夏（D错）四时、秋、冬分别与五行木、火、土、金、水对应。辛对应金，长夏对应土。